对新建、改建和扩建的工矿企业进行验收或对劳动卫生防护的效果进行卫生学评价时，要连续监测（）次
A. 1
B. 2
C. 3
D. 4
E. 5

正确答案：C。3